人体实验中应放在首位的是
A. 实验者利益
B. 经济利益
C. 社会利益
D. 科学利益
E. 受试利益

正确答案：E。受试利益

解析：人体实验力求使受试者最大程度受益和尽可能避免伤害（E对），强调对受试者利益的考虑必须高于对科学和社会利益的考虑（ABCD错）。